维生素K缺乏时，不会出现的实验室检查结果是
A. PT延长
B. APTT延长
C. CT延长
D. FDP增加
E. FNP升高

正确答案：D。FDP增加

解析：维生素K缺乏时，不会出现的实验室检查结果是FDP增加，因为FDPs阳性或增高见于原发性纤溶和继发性纤溶。维生素K缺乏时，导致FⅡ、FⅦ、FⅨ、FⅩ因子的生成缺乏，导致内源性及外源性凝血异常，故导致PT、APTT、CT延长，FNP升高（ABCE对）。